下列哪个人群不会发生脚气病
A. 高糖饮食的人中
B. 食用高度精细加工米面的人中
C. 食用粗谷粗粮的人中
D. 慢性酒精中毒的人中
E. 以上都不正确

正确答案：C。食用粗谷粗粮的人中

解析：脚气病是由维生素B₁缺乏引起，维生素B₁又名硫胺素，主要存在于豆类和种子外皮（如米糠）、胚芽、酵母和瘦肉中。因此食用粗谷粗粮的人中（C对）不会发生脚气病。